牙髓坏死与慢性根尖周炎鉴别要点是
A. 牙龈有瘘管
B. 牙髓有活力
C. 温度测试一过性敏感
D. X线片根尖周影像不同
E. 牙体硬组织有缺损

正确答案：D。X线片根尖周影像不同

解析：有瘘型的慢性根尖周炎有瘘管，而无瘘型则没有瘘管，最明显的区别为慢性根尖周炎X线片表现为根尖周骨密度减低影像或根周膜影像模糊增宽。掌握“牙髓坏死、牙髓钙化与牙内吸收”知识点。